患者喘促日久，动则喘甚，呼多吸少，气不得续，汗出肢冷，跗肿，面青唇紫，舌淡苔白，脉沉弱。其治疗应首选
A. 平喘固本汤合补肺汤
B. 金匮肾气丸合参蛤散
C. 参附汤合黑锡丹
D. 生脉散合补肺汤
E. 生脉地黄汤合金水六君煎

正确答案：B。金匮肾气丸合参蛤散

解析：题中患者以喘促为主要症状，故诊断为喘证。喘促日久，动则喘甚，呼多吸少，气不得续为久病肺虚及肾，气失摄纳所致，气虚及阳，阳虚卫外不固，则汗出。阳气虚弱，肢体失于温煦，故见肢冷，面青唇紫。阳虚气不化水，故见跗肿。舌淡苔白，脉沉弱为肾气虚衰之象，故诊断为喘证虚喘之肾虚不纳证。治宜补肾纳气。用金匮肾气丸合参蛤散治疗（B对）。平喘固本汤合补肺汤为肺胀肺肾气虚证的选方，功能补肺纳肾，降气平喘（A错）。参附汤合黑锡丹为喘证虚喘之正虚喘脱证的选方，功能扶阳固脱，镇摄肾气（C错）。生脉散合补肺汤为喘证虚喘之肺气虚耗证的选方，功能补肺益气养阴（D错）。生脉地黄汤合金水六君煎为哮病缓解期肺肾两虚证的选方，功能补肺益肾（E错）。